根据《非处方药专有标识管理规定（暂行）》，红色专有标识图案用于
A. 需放于冷藏处贮存的药品
B. 需放于阴凉处贮存的药品
C. 甲类非处方药
D. 乙类非处方药
E. 经营非处方药的指南性标志

正确答案：C。甲类非处方药

解析：本题考查非处方药专有标识管理。根据《非处方药专有标识管理规定（暂行）》，红色专有标识图案用于甲类非处方药（C对）。非处方药专有标识图案分为红色和绿色，红色专有标识用于甲类非处方药药品，绿色专有标识用于乙类非处方药（D错）药品和用作指南性标志（E错）。